常用的菌斑显示剂
A. 品红溶液
B. 龙胆紫
C. 红汞
D. 刚果红
E. 碘酊

正确答案：A。品红溶液

解析：本题考查常用的菌斑显示剂。使用菌斑显示剂观察菌斑时，常用的菌斑染色剂有：品红溶液（A对），藻红，酒石黄，孔雀绿，荧光素钠。龙胆紫（B错）是一种碱性阳离子染料，外用可治疗皮肤及黏膜的创伤感染及溃疡。红汞（C错）是一种作用较弱的消毒性防腐药。刚果红（D错）为常见的酸碱指示剂，也可用于诊断淀粉样病变。碘酊（E错）是常见的杀菌消毒制剂。